某女，56岁。胃脘隐隐灼痛，似饥而不欲食，口干咽燥，五心烦热，消瘦乏力，大便干结；舌红少津，脉细数。医师诊断为胃痛，证属胃阴亏耗，治以一贯煎（沙参、麦冬、当归、地黄、枸杞子、川楝子）合芍药甘草汤（芍药、甘草）加减。关于该方剂中饮片品种选择的说法，错误的是
A. 沙参宜选用北沙参
B. 当归宜选用当归身
C. 地黄宜选生地黄
D. 川楝子宜选用生川楝子
E. 芍药宜选用生白芍

正确答案：D。川楝子宜选用生川楝子

解析：本题考查的是胃痛之胃阴亏耗证的方剂应用。关于该方剂中饮片品种选择的说法，错误的是川楝子宜选用生川楝子（D错，为本题正确答案）。胃痛之胃阴亏耗证【症状】胃脘隐隐灼痛，似饥而不欲食，口干咽燥，口渴思饮，五心烦热，消瘦乏力，大便干结。舌红少津，脉细数。【治法】养阴益胃，和中止痛。【方剂应用】1.基础方剂 一贯煎（沙参、麦冬、当归、生地黄（C对）、枸杞子、川楝子）合芍药甘草汤（芍药、甘草）加减。2.合理用药与用药指导（1）饮片选择：一贯煎出自清代《柳州医话》。宜选用伞形科的北沙参（A对），善清肺养阴，益胃生津；选用生麦冬，善养阴生津；选用当归身（B对），养血而守中；选用炒川楝子，苦寒之性减弱，无损阳伤胃之弊。芍药甘草汤出自东汉《伤寒论》。选用生白芍（E对），养血柔肝，平肝滋阴力强；选用清炙甘草，益气和胃，调和药性。